非水滴定法测定维生素B₁原料药的含量，应选
A. 淀粉指示剂
B. 喹哪啶红-亚甲蓝混合指示剂
C. 二苯胺指示剂
D. 邻二氮菲指示剂
E. 酚酞指示剂

正确答案：B。喹哪啶红-亚甲蓝混合指示剂